牛黄醒消丸是治疗乳痈、乳岩的常用中成药，其除能清热解毒、消肿止痛外，又能
A. 活血祛瘀
B. 消痰软坚
C. 祛腐生肌
D. 消痈排脓
E. 破气散结

正确答案：A。活血祛瘀

解析：本题考查牛黄醒消丸的功能。牛黄醒消丸是治疗乳痈、乳岩的常用中成药，其除能清热解毒、消肿止痛外，又能活血祛瘀（A对）。牛黄醒消丸【功能】清热解毒，活血祛瘀，消肿止痛。内消瘰疬丸【功能】化痰，软坚，散结（B错）。珠黄散【功能】清热解毒，祛腐生肌（C错）。鱼腥草【功效】清热解毒，排脓消痈（D错），利尿通淋。青皮苦降下行，辛温行散，药力颇强，善破气散结（E错）、消积化滞。